30岁，G1P0，孕37+2周，已确诊为前置胎盘，出血多，血压9.33/6.67kPa，宫口开大4cm，胎头棘上2cm，胎心尚好，应选
A. 头皮钳术
B. 人工破膜术
C. 胎头吸引术
D. 剖宫产术
E. 产钳术

正确答案：D。剖宫产术

解析：“已确诊为前置胎盘，出血多”只能采取剖宫产术。前置胎盘，出血多，血9.33/6.67kPa（即70/50mmHg），说明血压低，有失血性休克可能。宫口已开大4cm，胎头还位于棘上2cm，说明孕妇已临产，胎儿不能很好入盆。综上应立即选择剖宫产术终止妊娠。掌握“前置胎盘”知识点。